防风通圣散的主治病症是
A. 身热下利，胸脘灼热，舌红苔黄，脉数
B. 往来寒热，胸胁苦满，苔黄，脉弦数有力
C. 憎寒壮热，胸膈痞闷，舌苔黄腻，脉数有力
D. 往来寒热，胸胁苦满，舌苔薄白，脉弦
E. 寒热如疟，胸胁胀痛，舌红苔白腻，脉数右滑左弦

正确答案：C。憎寒壮热，胸膈痞闷，舌苔黄腻，脉数有力

解析：防风通圣散功用疏风解表，泻热通便。主治风热壅盛，表里俱实证。风热之邪在表，正邪相争，以致憎寒壮热；风热上攻，则头目昏眩、目赤睛痛、咽喉不利；内有蕴热，肺胃受邪，故见胸膈痞闷、咳呕喘满、涕唾稠黏、口苦口干、便秘溲赤。风热壅盛，表里俱实，故舌苔黄腻，脉数有力（C对）。